在交付毒性、成瘾性药品时给予购药者明确的口头提示或薯告，是
A. 执业药师的权力
B. 执业药师的义务
C. 执业药师的权利
D. 执业药师的执业行为规范
E. 执业药师的道德准则

正确答案：D。执业药师的执业行为规范